近年来，涉及中药注射剂不良反应的报道较多，执业药师应高度关注。中药注射剂临床使用中最常见的不良反应是
A. 生殖毒性
B. 致癌作用
C. 过敏反应
D. 消化道反应
E. 血液系统损害

正确答案：C。过敏反应

解析：本题考查的是中药注射液的不良反应。中药注射剂临床使用中最常见的不良反应是过敏反应（C对）。中药注射剂如清开灵注射液、双黄连注射液、参麦注射液、莲必治注射液、穿琥宁注射液、炎琥宁注射液、生脉注射液等，不良反应表现为过敏反应。生殖毒性（A错）是雷公藤的不良反应表现。雷公藤的不良反应表现：①消化系统：腹痛、腹泻，恶心、呕吐，食欲不振，肝损害，少数可致伪膜性肠炎，严重者可致消化道出血。②血液系统：血小板、白细胞、血红蛋白减少，严重者可发生急性粒细胞减少、再生障碍性贫血等。③生殖系统：对男性患者雷公藤可抑制精细胞中酶的活性，导致精子产生和成熟发生障碍，表现为精子数量显著减少，长期用药还会导致性欲减退、睾丸萎缩；对女性患者雷公藤可抑制其卵巢功能，表现为月经紊乱、经量减少、卵巢早衰。④神经系统：头晕、乏力、失眠、听力减退、嗜睡、复视，还可引起周围神经炎。⑤泌尿系统：主要表现为急性肾功能衰竭，服药后迅速出现或逐渐发生少尿、水肿、血尿、蛋白尿、管型尿、腰痛或伴肾区叩击痛，常常发生于过量中毒时。⑥心血管系统：心悸、胸闷、心动过缓、气短、心律失常、心电图改变（ST-T改变），严重者可见血压急剧下降，个别出现室颤、心源性休克而死亡。⑦皮肤黏膜损害：皮肤糜烂、溃疡、斑丘疹、荨麻疹、瘙痒等。致癌作用（B错）是细辛的中毒反应症状。细辛的不良反应表现：细辛中的挥发油直接作用于中枢神经系统，最终可因呼吸中枢完全麻痹而致死。细辛的急性毒性对小鼠肺、肝、肾等重要脏器均有明显损害，其中对肺脏的病理损害最为严重。细辛中毒时，常可出现头痛、呕吐、出汗、口渴、烦躁不安、面赤、呼吸急促、脉数、瞳孔散大，体温血压均升高；个别出现心慌、气短、胸闷，动则加重，窦性心动过速及双下肢水肿等急性心力衰竭症状，或精神紧张，失眠，胆小易惊，心悸、濒死感，面色萎黄灰暗，多发性阵发性窦性心动过速等心律失常伴自主神经紊乱等。严重者可出现牙关紧闭、角弓反张、意识不清、四肢抽搐、尿闭，最后因呼吸麻痹而死亡。消化道反应（D错）是鸦胆子等的不良反应表现。鸦胆子的不良反应表现：①消化道症状：恶心、呕吐，食欲不振，腹痛、腹泻，便血，胃肠道充血等。②神经系统：头昏、乏力，体温增高，四肢麻木或瘫痪，昏迷、抽搐等。③泌尿系统：尿量减少，双肾刺痛。④心血管系统：心率增快，严重者可心律失常致死。⑤其他：眼结膜充血；外用可引起过敏反应。血液系统损害（E错）是维C银翘片的不良反应表现。维C银翘片的不良反应表现：皮肤及附属器损害，表现为全身皮疹伴瘙痒、严重荨麻疹、重症多形红斑型药疹、大疱性表皮松解症；消化系统损害，表现为肝功能异常；全身性损害，表现为过敏性休克、过敏样反应、昏厥；泌尿系统损害，表现为间质性肾炎；血液系统损害，表现为白细胞减少、溶血性贫血。